下列非为实证者是
A. 大便秘结
B. 小便短涩
C. 痰涎壅盛
D. 腹痛拒按
E. 五心烦热

正确答案：E。五心烦热

解析：本题考查的是实证的临床表现及辨证要点。下列非为实证者是五心烦热（E错，为本题正确答案）。实证，是指邪气过盛所反映出来的一类证候。形成实证有两方面的原因，一是外邪侵入人体，一是由于内脏功能失调，代谢障碍，以致痰饮、水湿、瘀血等病理产物停留在体内所致。一般说来，实证虽属邪气过盛所致，但正气犹能抵抗，未至亏损的程度，故实证往往表示邪正斗争处于激烈的阶段。由于实邪的性质及所在部位的不同，实证的临床表现亦极不一致。主要有：发热，腹胀痛拒按（D对），胸闷烦躁甚至神昏谵语，呼吸喘粗，痰涎壅盛（C对），大便秘结（A对），小便不利（B对），脉实有力，舌苔厚腻等。以症状表现有余、亢盛为辨证要点。五心烦热属于虚证。虚证，指人体正气不足所表现的证候。其虽有阴、阳、气、血虚损的区分，但凡属虚证者，皆为人体正气不足所表现的证候。虚证的形成，有先天不足和后天失养两个方面，但以后天失于调养为主。如饮食失调，后天之本不固，七情劳倦，内伤脏腑气血，房事过度，耗散肾脏元真，或久病以及失治、误治损伤正气等，均可致成虚证。虚证有阴虚、阳虚、气虚、血虚等多种证候的不同，所以临床表现亦极不一致，很难概括全面。常见的有：面色苍白或萎黄，精神萎靡，身疲乏力，心悸气短，形寒肢冷或五心烦热，自汗盗汗，大便滑脱，小便失禁，舌上少苔无苔，脉虚无力等。以症状表现为不足、虚弱为辨证要点。